男性，50岁，胃溃疡病史25年，饭后突发上腹剧痛1小时。为进一步明确诊断，首选的检查方法是
A. 腹腔诊断性穿刺
B. 立位腹部X线平片
C. CT检查
D. B超检查
E. X线胃肠钡餐检查

正确答案：B。立位腹部X线平片

解析：胃溃疡病史，突发上腹剧痛考虑胃穿孔，首选立位腹部X线平片，可在膈下见到游离气体（B对）。